枳实导滞丸除能消积导滞外，还能
A. 活血止痛
B. 健脾和胃
C. 清利湿热
D. 通腑降浊
E. 健脾利湿

正确答案：C。清利湿热

解析：本题考查的是枳实导滞丸的功能。枳实导滞丸除能消积导滞外，还能清利湿热（C对）。枳实导滞丸：【功能】消积导滞，清利湿热。六味安消散：【功能】和胃健脾，消积导滞，活血止痛（A错）。开胃健脾丸：【功能】健脾和胃（B错）。尿毒清颗粒：【功能】通腑降浊（D错），健脾利湿（E错），活血化瘀。